鉴别肝阳上亢证与肝火炽盛证最有意义的临床表现是
A. 失眠多梦
B. 急躁易怒
C. 头重脚轻
D. 面红耳赤
E. 头晕胀痛

正确答案：C。头重脚轻

解析：肝阳上亢证的证候表现：头目胀痛，眩晕耳鸣，面红目赤，急躁易怒，失眠多梦，腰膝酸软，头重脚轻，舌红少津，脉弦或弦细数。肝火炽盛证的证候表现：指火热炽盛，内扰于肝，气火上逆，以头痛、胁痛、烦躁、耳鸣及实热症状为主要表现的证。失眠多梦 （A错）、急躁易怒（B错）、面红耳赤（D错） 、头晕胀痛（E错）是肝阳上亢证与肝火炽盛证的共有症状。头重脚轻为肝阳上亢证的特有证候，对鉴别肝阳上亢证与肝火炽盛证最有意义（C对）。